腹膜内位器官，不包括
A. 胃
B. 肝
C. 横结肠
D. 脾
E. 阑尾

正确答案：B。肝

解析：胃（A对）、十二指肠上部、空肠、回肠、盲肠、阑尾（E对）、横结肠（C对）、乙状结肠、脾（D对）、卵巢和输卵管为腹膜内位器官。肝（B错，为本题正确答案）为腹膜间位器官。